减少钠离子内流而使神经细胞膜稳定，属于乙内酰脲类抗癫痫药的是
A. 卡马西平
B. 苯妥英钠
C. 丙戊酸钠
D. 苯巴比妥
E. 氯硝西泮

正确答案：B。苯妥英钠

解析：本题考查乙内酰脲类抗癫痫药。苯妥英钠（B对）可减少钠离子内流而使神经细胞膜稳定，属于乙内酰脲类抗癫痫药；卡马西平（A错）主要阻滞电压依赖性的钠通道，属于二苯并氮䓬类抗癫痫药；丙戊酸钠（C错）为脂肪酸类抗癫痫药，其作用机制为抑制γ-氨基丁酸（GABA）的降解或促进其合成；苯巴比妥（D错）属于巴比妥类抗癫痫药，通过增强γ-氨基丁酸A型受体活性发挥作用；氯硝西泮（E错）可激动γ-氨基丁酸（GABA）受体和钠通道，属于苯二氮䓬类抗癫痫药。